每100kcal热量的混合膳食产生的内生水是
A. 8ml
B. 10ml
C. 12ml
D. 14ml
E. 16ml

正确答案：C。12ml

解析：食物内生水是指食物在体内氧化可产生一小部分水。每100Kcal热量的混合膳食产生约12g水，由于水的比重是1.0，即产生12ml水（C对）。